根据药物对胎儿的危害，美国FDA分为A、B、C、D、X五个级别，属于A级药物的是
A. 阿莫西林
B. 葡萄糖
C. 万古霉素
D. 沙利度胺
E. 卡马西平

正确答案：B。葡萄糖

解析：本题考查药物妊娠毒性分级。根据药物对胎儿的危害，美国FDA分为A、B、C、D、X五个级别，属于A级药物的是葡萄糖（B对）。 A级是指在有对照组的妊娠早期妇女中未显示对胎儿有危险（并在妊娠中、晚期亦无危险的证据），可能对胎儿的伤害极小。包括葡萄糖、维生素A、维生素B₂、维生素D、维生素E、维生素K、左甲状腺素钠、叶酸、泛酸、KCl。阿莫西林（A错）为B级药物。万古霉素（C错）为C级药物。沙利度胺（D错）为X级药物。卡马西平（E错）为D级药物。